关于脊神经的说法中,何者错误
A. 各脊神经都以两个根起自脊髓
B. 前根较细,属运动性的
C. 后根较粗,属感觉性的
D. 前根上有一个神经节
E. 两根在椎间孔处合成脊神经

正确答案：D。前根上有一个神经节

解析：每队脊神经均由前根和后根组成（A对），前根较细，由运动性神经根丝构成（B对），后根较粗，由感觉性神经根丝构成（C对），前根和后根在椎间孔处合为一条脊神经（E对）。脊神经后根在椎间孔处有椭圆形的膨大，称脊神经节（D错，为本题正确选项）。